牙周膜中可见小的上皮条索或上皮团，与牙根表面平行排列的组织为
A. 成纤维细胞
B. 牙周膜干细胞
C. 成牙骨质细胞
D. Malassez上皮剩余
E. 成骨细胞

正确答案：D。Malassez上皮剩余

解析：上皮剩余：又称Malassez上皮剩余。在牙周膜中，邻近牙表面的纤维间隙中可见到小的上皮条索或上皮团，与牙根表面平行排列。掌握“牙周膜”知识点。